下列病症中，不属于六味地黄丸主治病证临床表现的是
A. 腰膝酸软，盗汗遗精
B. 耳鸣耳聋，头晕目眩
C. 骨蒸潮热，手足心热
D. 小便不利或反多
E. 舌红少苔，脉沉细数

正确答案：D。小便不利或反多

解析：六味地黄丸主治腰膝酸软，盗汗，遗精（A对）头晕目眩，耳鸣耳聋（B对），视物昏花，消渴，骨蒸潮热，手足心热（C对），舌燥咽痛，牙齿动摇，足跟作痛，小儿囟门不合，舌红少苔，脉沉细数，治宜补肾之阴精为主，兼以清降虚火，即王冰所谓“壮水之主，以制阳光”（E对）（D错，为本题正确答案）。